关于楔束的描述，错误的是
A. 由脊神经节发出的纤维组成
B. 终止于同侧延髓的楔束核
C. 在脊髓后索内上行
D. 位于薄束的外侧
E. 传导下肢的本体感觉和精细触觉

正确答案：E。传导下肢的本体感觉和精细触觉

解析：楔束参与躯干和四肢意识性本体感觉的精细触觉传导通路。该通路由3级神经元组成：第1级神经元为脊神经节内假单极神经元，第2级神经元的胞体在薄、楔束核内。楔束位于薄束的外侧（D对），由脊神经节发出的纤维组成（A对），在脊髓后索内上行（C对），终止于同侧延髓的楔束核（B对）。薄束和楔束传导躯干和四肢意识性本体感觉的精细触觉（E错，为本题正确选项）。